恒牙列中，龋病最好发的牙位是
A. 下颌第一磨牙
B. 下颌第二磨牙
C. 前磨牙
D. 上前牙
E. 下前牙

正确答案：A。下颌第一磨牙

解析：本题考查龋病的好发牙位。恒牙列中，龋病最好发的牙位是下颌第一磨牙（A对）。其次是下颌第二磨牙（B错）、上颌第一磨牙、上颌第二磨牙、前磨牙（C错）、第三磨牙、上前牙（D错），下前牙（E错）患龋率最低。